既补血活血，又调经润肠的药是
A. 红花
B. 当归
C. 熟地黄
D. 肉苁蓉
E. 月季花

正确答案：B。当归

解析：本题考查的是当归的功效。既补血活血，又调经润肠的药是当归（B对）。当归：【功效】补血活血，调经止痛，润肠通便。红花（A错）：【功效】活血通经，祛瘀止痛。熟地黄（C错）：【功效】补血滋阴，补精益髓。肉苁蓉（D错）：【功效】补肾阳，益精血，润肠通便。月季花（E错）：【功效】活血调经，疏肝解郁。